下列不属于我国学者从自杀预防的角度考虑进行自杀行为分类的是
A. 自杀意念
B. 自杀准备
C. 自杀未遂
D. 自杀死亡
E. 自我损伤

正确答案：E。自我损伤

解析：本题考查我国自杀行为分类。我国将自杀行为分为以下5类：①自杀意念（A对）；②自杀计划；③自杀准备（B对）；④自杀未遂（C对）；⑤自杀死亡（D对）。自我损伤（E错，为本题正确答案）不属于自杀行为的分类。